与流脑患者密切接触后的重要预防措施是
A. 菌苗预防注射
B. 隔离观察
C. 注射青霉素
D. 口服磺胺药
E. 开窗通风

正确答案：D。口服磺胺药

解析：与流脑患者密切接触后，除医学观察外，可用磺胺甲恶唑进行药物预防（D对），剂量为成人每日2g，儿童50～100mg/kg，连用3 日。另外，利福平、头孢曲松、氧氟沙星等也能起到良好的预防作用。